以下关于根管冲洗液的叙述不正确的是
A. 5.25％次氯酸钠及3％过氧化氢交替使用可产生新生态氧，有发泡作用
B. 次氯酸钠是坏死组织的良好溶解剂
C. EDTA对扩大硬化或弯曲根管有效
D. 液体都能提供润滑作用
E. 对牙根发育不全的根管选择次氯酸钠液冲洗

正确答案：E。对牙根发育不全的根管选择次氯酸钠液冲洗

解析：本题考查根管冲洗。以下关于根管冲洗液的叙述不正确的是对牙根发育不全的根管选择次氯酸钠液冲洗（E错，为本题的正确答案）。根管发育不全不能形成有效回流，选择次氯酸钠冲洗效果不佳。3%过氧化氢遇组织中的过氧化氢酶释放新生氧，发泡作用有助于清除坏死组织，临床上常与次氯酸钠联合应用，次氯酸钠推荐浓度为0.5%-5.25%，浓度越高，溶解组织能力越强（AB对）。EDTA可以使钙化的阻塞物易于去除，对硬化或弯曲根管有效（C对）。冲洗液的一个目的就是润滑管壁（D对），防止器械折断。